真菌细胞不具有的结构或成分是
A. 细胞壁
B. 细胞核
C. 线粒体
D. 内质网
E. 叶绿素

正确答案：E。叶绿素

解析：真菌是真核细胞型微生物，细胞结构比较完整，有典型的细胞核和完善的细胞器，不含叶绿素，无根，茎，叶的分化。掌握“真菌概述及主要病原性真菌”知识点。